体育课准备部分适宜分配时间为
A. 2～3分钟
B. 3～7分钟
C. 6～12分钟
D. 15～20分钟
E. 25～30分钟

正确答案：C。6～12分钟